哪类属于高温、高湿作业
A. 印染作业
B. 轧钢、炼钢、炼铁作业
C. 缝纫作业
D. 印刷作业
E. 建筑、修路夏季施工

正确答案：A。印染作业